男，38岁。会阴部不适，双侧睾丸疼痛1年。社区医院按“前列腺炎”治疗，效果不明显。近期症状加重，出现血精。查体：睾丸正常，左侧附睾尾部肿大，质地偏硬，左输精管增粗，呈“串珠状”改变。直肠指检前列腺略大，有大小不等的结节，无压痛。最可能的诊断是
A. 前列腺癌
B. 附睾输精管炎
C. 精囊炎
D. 慢性前列腺炎
E. 生殖系结核

正确答案：E。生殖系结核

解析：青年男性患者，会阴部不适，双侧睾丸疼痛，按“前列腺炎”治疗效果不明显，近期症状加重，出现血精（提示可能有前列腺、精囊结核），查体睾丸正常，左侧附睾尾部肿大、质地偏硬（提示可能有附睾结核），左输精管增粗，呈“串珠状”改变（输精管结核典型表现），直肠指检前列腺略大，有大小不等的结节，无压痛（提示可能有前列腺结核），结合患者病史、症状和及相关检查，最可能的诊断为生殖系结核（E对）。前列腺癌（A错）主要见于老年男性，多无明显临床症状，血尿少见。附睾输精管炎（B错）主要表现为患侧阴囊坠胀疼痛、红肿，腹部及大腿根部放射痛，体检有阴囊段输精管增粗变硬，抗生素治疗有效。精囊炎（C错）多由逆行感染所致，主要表现为疼痛、膀胱刺激症状和血精，可有发热、寒战，直肠检查时精囊肿大，有波动和压痛，精液细胞学检查可与肿瘤及结核相鉴别。慢性前列腺炎（D错）主要表现为疼痛、膀胱刺激症状和排尿时不适感，直肠指检前列腺呈饱满、增大、质软、轻度压痛，抗生素治疗有效。